慢性阻塞性肺疾病在用力呼吸时，呼气困难加重是由于
A. 用力呼吸导致呼吸肌疲劳
B. 胸内压增高
C. 肺泡扩张压迫小气道
D. 小气道阻力增加
E. 等压点移向小气道

正确答案：E。等压点移向小气道

解析：慢性阻塞性肺疾病时，由于小气道的阻塞，患者在用力呼气时，气体通过阻塞部位形成的压差较大，使阻塞部位以后的气道内压低于正常，以致等压点由大气道上移至无软骨支撑的小气道（E对），在用力呼气时小气道外的压力大千小气道内的压力，使气道阻塞加重，甚至使小气道闭合。